嗜酸性腺瘤的临床特点表现为
A. 生长缓慢的痛性炎症肿块
B. 生长快速的颌骨恶性肿瘤
C. 生长缓慢的无痛炎性肿块
D. 生长快速的无痛性脓肿
E. 生长缓慢的无痛性肿块

正确答案：E。生长缓慢的无痛性肿块

解析：嗜酸性腺瘤临床上表现为生长缓慢的无痛性肿块。掌握“沃辛瘤及嗜酸性腺瘤”知识点。